婴儿30天内萌出的牙称为
A. 新生牙
B. 双生牙
C. 结合牙
D. 融合牙
E. 诞生牙

正确答案：A。新生牙

解析：本题考查牙齿萌出过早。婴儿30天内萌出的牙称为新生牙（A对）。新生牙：是指出生后30天内萌出的牙齿。双生牙（B错）：是牙胚在发育期间，成釉器内陷将牙胚分开而形成的畸形牙，表现为牙冠的完全或不完全分开，但有一个共同的牙根和根管。乳牙列和恒牙列均可发生。结合牙（C错）：是2颗或2颗以上基本发育完成的牙齿，由于牙齿拥挤或创伤，使两个牙根靠拢，由增生的牙骨质将其结合在一起而成。可发生在牙齿萌出前或萌出后。融合牙（D错）：是由两个正常牙胚的牙釉质或牙本质融合在一起而成，极少数情况可出现两个以上牙胚融合。除牙齿发育受压力因素影响外，还有遗传倾向。诞生牙（E错）：是指婴儿出生时口腔内己萌出的牙齿。